气行血功能失常可见
A. 气虚血少
B. 气虚血瘀
C. 气虚出血
D. 气虚血脱
E. 血虚气亏

正确答案：B。气虚血瘀

解析：气行血，指气能推动与调控血液在脉中稳定运行。如果气的亏少则无力推动血行，或气机郁滞不能推动血行，都能够产生血瘀的病变，因此气机调畅对于血液正常运行尤为重要（B对）。气虚血少（A错）由于气能生血功能失常所致。气虚出血（C错）由于气的摄血功能失常所致。气虚血脱（D错）由于气的摄血功能严重失常所致。血虚津亏（E错）是血能养气功能异常。